关于特殊医学用途配方食品和婴幼儿配方食品管理的说法，错误的是
A. 特殊医学用途配方食品参照药品管理，应经国家食品药品管理总局注册
B. 特殊医学用途配方食品广告参照药品广告有关管理规定
C. 婴幼儿配方食品的产品配方应向省级药品监督管理部门注册
D. 婴幼儿配方食品生产应实施全过程质量控制，实施逐批检验

正确答案：C。婴幼儿配方食品的产品配方应向省级药品监督管理部门注册

解析：本题考查特殊医学用途配方食品和婴幼儿配方食品的管理。婴幼儿配方食品生产企业应当将食品原料、食品添加剂、产品配方及标签等事项向省（区、市）人民政府市场监督管理部门备案（C错，为本题正确答案）。特殊医学用途配方食品和婴幼儿配方食品的管理：特殊医学用途配方食品，是指为了满足进食受限、消化吸收障碍、代谢紊乱或特定疾病状态人群对营养素或膳食的特殊需要，专门加工配制而成的配方食品，包括适用于1岁以上人群的特殊医学用途配方食品和适用于0月龄至12月龄的特殊医学用途婴儿配方食品。《食品安全法》将特殊医学用途配方食品参照药品管理的要求予以对待，规定该类食品应当经国家市场监督管理部门注册（A对）。注册时，应当提交产品配方、生产工艺、标签、说明书以及表明产品安全性、营养充足性和特殊医学用途临床效果的材料。另外，特殊医学用途配方食品广告也参照药品广告的有关管理规定予以处理（B对）。特殊医学用途配方食品注册号的格式为：国食注字TY+4位年号+4位顺序号，其中TY代表特殊医学用途配方食品。特殊医学用途配方食品注册证书有效期限为5年。婴幼儿配方乳粉产品配方，是指生产婴幼儿配方乳粉使用的食品原料、食品添加剂及其使用量，以及产品中营养成分的含量。婴幼儿配方食品生产企业应当实施从原料进厂到成品出厂的全过程质量控制，对出厂的婴幼儿配方食品实施逐批检验（D对），保证食品安全。生产婴幼儿配方食品使用的生鲜乳、辅料等食品原料、食品添加剂等，应当符合法律、行政法规的规定和食品安全国家标准，保证婴幼儿生长发育所需的营养成分。婴幼儿配方食品生产企业应当将食品原料、食品添加剂、产品配方及标签等事项向省（区、市）人民政府市场监督管理部门备案。婴幼儿配方乳粉产品配方应当经国务院市场监督管理部门注册批准。申请注册时，应当提交配方研发报告和其他表明配方科学性、安全性的材料。不得以分装方式生产婴幼儿配方乳粉，同一企业不得用同一配方生产不同品牌的婴幼儿配方乳粉。婴幼儿配方乳粉产品配方注册号格式为：国食注字YP+4位年代号+4位顺序号，其中YP代表婴幼儿配方乳粉产品配方。婴幼儿配方乳粉产品配方注册证书有效期为5年。